饮用水的基本卫生要求不包括
A. 净化消毒设施完善
B. 感官性状良好
C. 水量充足，取用方便
D. 流行病学上安全
E. 所含化学物质对人体无害

正确答案：A。净化消毒设施完善

解析：本题考查饮用水的基本卫生要求。饮用水的基本卫生要求是指饮用水的安全性和卫生性，包括水的品质和安全性、水的取用、储存和运输等，以确保饮用水满足卫生要求。因此，饮用水的基本卫生要求包括：流行病学上安全（D对）；水量充足，取用方便（C对）；感官性状良好（B对）；所含化学物质对人体无害（E对）。净化消毒设施完善（A错，为本题正确答案）不属于饮用水的基本卫生要求。